太阴虚寒腹痛的特点是
A. 上腹部疼痛
B. 下利腹痛
C. 时腹自痛
D. 腹满而痛
E. 下腹部疼痛

正确答案：C。时腹自痛

解析：太阴病以脾阳虚弱，运化失职，寒湿内盛，升降失常为基本病机。脾阳虚弱则失于温煦运化，寒湿内阻。气机壅滞，故见腹部胀满。脾胃为人体气机升降之枢纽，太阴脾阳虚弱，清阳不升，寒湿下趋则自发泄利；胃气不降，浊阴上逆则呕吐。脾虚不运，纳化失司，则食不下。自利是指自发性下利，非误治所致。“益甚”是指上述脾虚寒湿证，若失于治疗，脾虚不复，中阳虚弱日益加重，其泄利亦必日甚一日，故云“自利益甚”。时腹自痛是太阴虚寒腹痛的特点，乃因中焦阳虚，寒凝气滞，腹失温养所致，常表现为腹痛时作时止，喜温喜按。治疗当温中散寒，健脾燥湿，方用理中汤或丸（C对）。